log-rank检验属于
A. 参数法
B. 非参数法
C. 半参数法
D. logistic 回归
E. 以上均不是

正确答案：B。非参数法

解析：本题考查log-rank检验的性质。对数秩检验（log-rank test）是比较多组生存曲线的非参数（B对ACDE错）检验方法。